根据《中华人民共和国药品管理法实施条例》，药品监督管理部门应在规定的处罚幅度内从重处罚的有
A. 以维生素C注射液冒充哌替啶注射液
B. 生产销售含量为0.02%的白蛋白注射液
C. 销售未注明生产批号的感冒冲剂
D. 生产以淀粉为原料的幼儿补钙颗粒
E. 销售已过有效期的板蓝根颗粒

正确答案：A、B、D。以维生素C注射液冒充哌替啶注射液；生产销售含量为0.02%的白蛋白注射液；生产以淀粉为原料的幼儿补钙颗粒

解析：本题考查药品监督管理部门应在规定的处罚幅度内从重处罚的情形。根据《中华人民共和国药品管理法实施条例》，药品监督管理部门应在规定的处罚幅度内从重处罚的有以维生素C注射液冒充哌替啶注射液（A对）、生产销售含量为0.02%的白蛋白注射液（B对）、生产以淀粉为原料的幼儿补钙颗粒（D对）。《中华人民共和国药品管理法实施条例》第七十三条规定，违反《药品管理法》和本条例的规定，有下列行为之一的，由药品监督管理部门在《药品管理法》和本条例规定的处罚幅度内从重处罚：（一）以麻醉药品、精神药品、医疗用毒性药品、放射性药品冒充其他药品，或者以其他药品冒充上述药品的；（二）生产、销售以孕产妇、婴幼儿及儿童为主要使用对象的假药、劣药的；（三）生产、销售的生物制品、血液制品属于假药、劣药的；（四）生产、销售、使用假药、劣药，造成人员伤害后果的；（五）生产、销售、使用假药、劣药，经处理后重犯的；（六）拒绝、逃避监督检查，或者伪造、销毁、隐匿有关证据材料的，或者擅自动用查封、扣押物品的。